治疗喘证痰浊阻肺证，应首选的方剂是
A. 射干麻黄汤
B. 麻黄汤合华盖散
C. 二陈汤合三子养亲汤
D. 三拗汤合止嗽散
E. 生脉散合补肺汤

正确答案：C。二陈汤合三子养亲汤

解析：痰浊阻肺证之实喘是由中阳不运，积湿生痰，痰浊壅肺，肺失肃降所致，治宜祛痰降逆，宣肺平喘，方用二陈汤合三子养亲汤（C对）。射干麻黄汤为冷哮代表方（A错）。麻黄汤合华盖散为风寒壅肺证之实喘的代表方（B错）。三拗汤合止嗽散为风寒袭肺证之外感咳嗽代表方（D错）。生脉散合补肺汤为肺气虚耗证之虚喘的代表方（E错）。